女性患儿，因为牙面发黑前来治疗。检查发现，上颌乳尖牙的唇面有黑色的斑块，通过X线片和探诊检查可以确诊为浅龋，欲使用氟化钠溶液进行浅龋的治疗，关于其治疗步骤内容的叙述下列说法错误的是
A. 龋损周围有尖锐边缘时，需要修整外形
B. 涂药前去除软垢时可借助菌斑染色剂
C. 在清洁牙面时选择使用含有碳酸钙磨料的摩擦剂
D. 牙面清洁后需要吹干，并使用棉卷隔湿
E. 因为儿童唾液分泌量较大，所以需要使用吸唾器进行排唾

正确答案：C。在清洁牙面时选择使用含有碳酸钙磨料的摩擦剂

解析：本题考查乳牙龋病的治疗。本病例中关于其治疗步骤内容的叙述说法错误的是在清洁牙面时选择使用含有碳酸钙磨料的摩擦剂（C错，为本题正确答案）。当用含氟药物涂布者，清洁牙面时不宜使用含碳酸钙的摩擦剂，因药物中的氟离子容易和碳酸钙中的钙离子结合形成氟化钙，影响氟化物对牙齿的作用。乳牙龋病的治疗步骤主要包括以下几步：1.修整外形：当龋损周围有明显的无基釉或尖锐边缘时，应该予以去除，修整外形，形成自洁区（A对）。2.清洁牙面、干燥防湿：涂药前去除牙面上的软垢。清洁前可借助菌斑染色剂，明确清除范围，以便彻底清洁（B对）。牙面清洁后需吹干，用棉卷隔湿（D对）、辅以吸唾器（E对），以免唾液污染牙面或将药物溢染他处。3.涂药：涂布药物要有足够的时间，使药液浸润牙面。使用有腐蚀性的药物时，药棉切忌浸药过多，结束时应拭去过多的药液，以免流及黏膜造成损伤。